评价治疗措施效果的主要指标是
A. 有效率、治愈率、生存率
B. 有效率、续发率、标化率
C. 治愈率、引入率、失访率
D. 有效率、续发率、标化率
E. 失访率、生存率、引入率

正确答案：A。有效率、治愈率、生存率